关于皮质脊髓侧束的说法错误的是
A. 主要由交叉的纤维组成
B. 其纤维向下终止于同侧前角
C. 管理同侧骨髂肌的随意运动
D. 属于上运动神经元
E. 其细胞体位于同侧中央前回和旁中央小叶前部

正确答案：E。其细胞体位于同侧中央前回和旁中央小叶前部

解析：皮质脊髓侧束是皮质脊髓束的分支之一，由对侧中央前回上、中部和中央旁小叶前半部等处皮质的锥体细胞轴突集中而成（E错，为本题正确选项）。经过内囊后肢，在脑干的腹侧部下行，75% -90%的纤维交叉至对侧（A对），形成锥体交叉，其纤维向下终止于同侧前角（B对），管理同侧骨髂肌的随意运动（C对），属于上运动神经元（D对）。